女，36岁。甲状腺功能亢进1年，甲状腺Ⅲ度肿大，待定手术治疗。空腹、安静、平卧位时，T37.8℃，P104次/分，BP130/90mmHg。应用简单方式计算出该患者的基础代谢率
A. 33kcal/d
B. 57kcal/d
C. 44kcal/d
D. 22kcal/d
E. 25kcal/d

正确答案：A。33kcal/d

解析：中青年女性患者，甲状腺功能亢进1年，甲状腺Ⅲ度肿大（甲状腺肿大的同时出现功能亢进多见于原发性甲亢），T37.8°C，P104次/分（P＞100次/分，提示脉率增快），BP130/90mmHg（脉压=40mmHg），综合患者的病史、体征，可诊断为患者为原发性甲亢。根据公式：基础代谢率=（脉率+脉压）-111，计算可得该患者的基础代谢率为33kcal/d（A对），为中度甲亢。